能与二硫化碳和硫酸酮反应
A. 麻黄碱
B. 伪麻黄碱
C. 二者均是
D. 二者均不是

正确答案：A。麻黄碱